根据《药品注册管理办法》，应当按照规定进行补充申请的是
A. 药品改变剂型
B. 药品改变给药途径
C. 药品改变适应症
D. 药品在原申请范围内补充说明的
E. 生产已批准上市的已有国家标准的药品

正确答案：D。药品在原申请范围内补充说明的

解析：本题考查药物临床试验。根据《药品注册管理办法》，应当按照规定进行补充申请的是药品在原申请范围内补充说明的（D对）。申办者评估认为不影响受试者安全的，可以直接实施并在研发期间安全性更新报告中报告。可能增加受试者安全性风险的，应当提出补充申请。